一般认为，牙源性囊肿的衬里上皮来源于
A. Serres上皮剩余
B. 牙源性上皮剩余
C. 牙板上皮剩余
D. 缩余釉上皮剩余
E. Malassez上皮剩余

正确答案：B。牙源性上皮剩余

解析：一般认为，牙源性囊肿的衬里上皮来源于牙源性上皮剩余，而不同囊肿可能来源于不同的上皮剩余。①牙板上皮剩余或Serres上皮剩余可发生发育性根侧囊肿和牙龈囊肿；②缩余釉上皮发生的囊肿有含牙囊肿、萌出囊肿以及炎性牙旁囊肿；③Malassez上皮剩余发生根尖周囊肿、残余囊肿和炎性根侧囊肿。需要强调的是，各种类型牙源性囊肿的诊断应综合考虑其临床、X线和组织病理表现。掌握“牙源性囊肿”知识点。